测定有害气体的采样器放置高度应为
A. 5m
B. 3～5m
C. 3m
D. 1.5～3m
E. 1.5m

正确答案：E。1.5m

解析：本题考查测定有害气体的高度。测定有害气体的采样器放置高度应为1.5m（E对ABCD错）。